根据《药品管理法》，丙药品批发企业（具有医用氧经营范围）从医用氧生产企业购进槽车液氧后分装为钢瓶装销售，此行为属于
A. 无证经营行为
B. 经营劣药行为
C. 无证生产行为
D. 经营假药行为

正确答案：C。无证生产行为

解析：本题考查的是违法生产药品的行为。根据《药品管理法》，丙药品批发企业（具有医用氧经营范围）从医用氧生产企业购进槽车液氧后分装为钢瓶装销售，此行为属于无证生产行为（C对）。从事药品生产活动，应当经所在地省、自治区、直辖市药品监督管理部门批准，依照规定取得《药品生产许可证》。无药品生产许可证的，不得生产药品。根据《药品管理法》第98条的规定，有下列情形之一的，为劣药（B错）：①药品成分的含量不符合国家药品标准；②被污染的药品；③未标明或者更改有效期的药品；④未注明或者更改产品批号的药品；⑤超过有效期的药品；⑥擅自添加防腐剂、辅料的药品；⑦其他不符合药品标准的药品。《药品管理法》第98条规定，禁止生产（包括配制，下同）、销售、使用假药。有下列情形之一的，为假药（D错）：①药品所含成分与国家药品标准规定的成分不符；②以非药品冒充药品或者以他种药品冒充此种药品；③变质的药品；④药品所标明的适应症或者功能主治超出规定范围。